银翘解毒丸既能清热解毒，又能
A. 疏风解表
B. 解表清热
C. 宣肺止咳
D. 益气解表
E. 解肌清热

正确答案：A。疏风解表

解析：本题考查的是银翘解毒丸的功能。银翘解毒丸既能清热解毒，又能疏风解表（A对）。银翘解毒丸：【功能】疏风解表，清热解毒。感冒清热颗粒：【功能】疏风散寒，解表清热（B错）。桑菊感冒片：【功能】疏风清热，宣肺止咳（C错）。参苏丸：【功能】益气解表（D错），疏风散寒，祛痰止咳。葛根芩连丸：【功能】解肌透表，清热（E错）解毒，利湿止泻。